为确立吸烟与肺癌的因果关系，必须满足的条件之一是
A. 肺癌患者同时也都是吸烟者
B. 在其他条件相同的情况下，吸烟者的肺癌发生率高于不吸烟者
C. 在其他条件相同的情况下，已戒烟者的肺癌发生率低于未戒烟者
D. 吸烟与肺癌存在强关联
E. 不同研究均得到一致的结果

正确答案：B。在其他条件相同的情况下，吸烟者的肺癌发生率高于不吸烟者

解析：本题考查因果关系。吸烟和肺癌的关系只能叫做关联关系，因为吸烟和非吸烟者肺癌发病率的差别可能是由吸烟以外的因素（如混杂）造成的，而吸烟和肺癌可能并没有任何关系，为确立吸烟与肺癌的因果关系，必须满足的条件之一是在其他条件相同的情况下，吸烟者的肺癌发生率高于不吸烟者（B对ACDE错）。